水与疾病的关系非常密切。居民通过洗涤、娱乐等活动直接或间接接触被细菌、病毒、原虫等生物性污染的水体时，最大的健康危害是可能引起
A. 水传播性传染病
B. 急性中毒
C. 藻类毒素中毒
D. 食物中毒
E. 水体富营养化现象

正确答案：A。水传播性传染病

解析：本题考查水与疾病的关系。居民通过洗涤、娱乐等活动直接或间接接触被细菌、病毒、原虫等生物性污染的水体时，最大的健康危害是可能引起水传播性传染病（A对BCDE错）。介水传染病是指通过饮用或接触病原体污染的水而传播的疾病，称介水传染病。介水传染病发生的原因有：①水源受病原体污染后，未经妥善处理和消毒即供居民饮用；②处理后的饮用水在输配水和贮水过程中重新被病原体污染。